颊间隙不与哪个间隙直接相连
A. 翼颌间隙
B. 咬肌间隙
C. 眶下间隙
D. 颞下间隙
E. 翼腭间隙

正确答案：E。翼腭间隙

解析：颊间隙与翼颌间隙、咬肌间隙、眶下间隙、颞下间隙及颞间隙等处的脂肪组织相连，成为感染相互扩散的途径。掌握“面侧深区及颌面部各间隙的境界”知识点。